喉腔借前庭襞、声襞分成喉前庭、喉中间腔和声门下腔3部分。关于喉中间腔的叙述，下列哪项是正确的
A. 又称喉室
B. 指声门裂以下的喉腔
C. 以前庭裂与声门下腔分界
D. 是喉腔3部中容积最小的部分
E. 此部黏膜下组织比较疏松，炎症时易引起水肿

正确答案：D。是喉腔3部中容积最小的部分

解析：喉中间腔向两侧经前庭襞与声襞间的裂隙至喉室（A错）。声门裂以下的喉腔是声门下腔（B错）。喉中间腔以声襞与声门下腔分界（C错）。喉中间腔是喉腔3部中容积最小的部分（D对）。